患者，女，54岁，诊断为类风湿关节炎2年，目前服用甲氨蝶呤（15mgqw）和塞来昔布（200mgqd）。患者因担心药品不良反应，用药不规律，时断时续，近日出现关节肿胀和疼痛加重，晨僵明显，加用泼尼松10mgqd。关于该患者健康教育的说法，错误的是
A. 早期治疗、遵医嘱规律用药
B. 多晒太阳，适量补充钙剂、维生素D，预防骨质疏松
C. 定期就诊，评估病情，调整治疗方案
D. 一旦症状改善，应即刻停药
E. 定期监测血常规、肝肾功能和粪隐血

正确答案：D。一旦症状改善，应即刻停药

解析：本题考查患者用药教育。类风湿性关节炎的患者教育：（1）类风湿性关节炎是一种慢性、以关节症状为主的全身性炎症性疾病，需要早期治疗（A对）、长期治疗（D错，为本题正确答案），避免致残。（2）需定期监测血常规、肝肾功能（E对）。（3）定期就诊，评估病情，调整治疗方案（C对）。（4）注意同时预防骨质疏松（B对）。